氨基苷类抗生素的主要不良反应是
A. 抑制骨髓
B. 耳毒性
C. 肝毒性
D. 心脏毒性
E. 消化道反应

正确答案：B。耳毒性

解析：氨基糖苷类抗生素的不良反应包括耳毒性（前庭功能障碍和耳蜗听神经损伤）、肾毒性（氨基糖苷类是诱发药源性肾衰竭的最常见因素，肾功能减退可使氨基糖苷类血浆浓度升高，这又进一步加重肾功能损伤和耳毒性）、神经肌肉阻滞、变态反应，其中肾毒性和耳毒性（B对）是主要的不良反应，其产生与服药剂量和疗效有关，用药期间应经常询问患者是否有眩晕、耳鸣等先兆。抑制骨髓（A错）（P393）为氯霉素类抗生素的不良反应。肝毒性（C错）为抗结核药物利福平的常见不良反应。心脏毒性（D错）、消化道反应（E错）（P397）为喹诺酮类抗生素的不良反应。